某男，48岁。反复胃脘疼痛多年。近日加重，症见胃脘隐隐灼痛、似饥而不欲食、口燥咽干、五心烦热、消瘦乏力、口渴思饮、大便干结，舌红少津、脉细数。医师诊为胃阴亏耗、中焦失和，治以养阴益胃、和中止痛。处方：北沙参10g、麦冬10g、生地黄10g、枸杞子10g、当归10g、炒川楝子5g、梅花3g、佛手5g、生白芍9g、灸甘草10g，7剂，每日1剂，水煎服。2个月后，患者又因暴饮暴食，出现脘腹胀满、嗳腐吞酸、不欲饮食。治宜消食、导滞、和胃，宜选用的中成药是
A. 胃苏颗粒
B. 开胃健脾丸
C. 保和丸
D. 六味安消散
E. 气滞胃痛颗粒

正确答案：C。保和丸

解析：本题考查保和丸的主治。治宜消食、导滞、和胃，宜选用的中成药是保和丸（C对）。保和丸【功能】消食，导滞，和胃。【主治】食积停滞，脘腹胀满，嗳腐吞酸，不欲饮食。胃苏颗粒（A错）【功能】理气消胀，和胃止痛。【主治】气滞型胃脘痛，症见胃脘胀痛、窜及两胁、得嗳气或矢气则舒、情绪郁怒则加重、胸闷食少、排便不畅、舌苔薄白、脉弦；慢性胃炎及消化性溃疡见上述证候者。开胃健脾丸（B错）【功能】健脾和胃。【主治】脾胃虚弱、中气不和所致的泄泻、痞满，症见食欲不振、嗳气吞酸、腹胀泄泻；消化不良见上述证候者。六味安消散（D错）【功能】和胃健脾，消积导滞，活血止痛。【主治】脾胃不和、积滞内停所致的胃痛胀满、消化不良、便秘、痛经。气滞胃痛颗粒（E错）（片）【功能】疏肝理气，和胃止痛。【主治】肝郁气滞，胸痞胀满，胃脘疼痛。